糖皮质激素抗炎作用的基本机制在于
A. 诱导血管紧张素转化酶而降解缓激肽
B. 可减少炎性介质白三烯等的生成
C. 抑制细胞因子介导的炎症
D. 抑制巨噬细胞中的一氧化氮合酶（NOS）
E. 与靶细胞浆内的糖皮质激素受体（GR）结合而影响了参与炎症的一些基因转录

正确答案：E。与靶细胞浆内的糖皮质激素受体（GR）结合而影响了参与炎症的一些基因转录